患者，女，30岁，已婚。月经先后无定期，质稀、量少，腰痛，头晕，舌淡少苔，脉沉细尺弱。其证候是
A. 肝郁
B. 肝血不足
C. 阴虚
D. 肾虚
E. 气血虚弱

正确答案：D。肾虚

解析：患者月经先后无定期，质稀量少是因为，肾气亏损，阴阳两虚，阴不足则经血少，阳不足则经色淡、质清稀，腰痛头晕则主要是因为肾气不足，气不化精，无法荣养腰府，上滋头目（D对）。肝郁证除月经先后无定期及经量色质的改变之外，会伴有胸胁乳房少腹胀痛，脘闷不舒，时叹息，嗳气食少的证候（A错）。